酶被底物饱和时，反应速度与之成正比的是
A. 底物浓度
B. 酶浓度
C. 激活剂
D. pH
E. 抑制剂

正确答案：B。酶浓度